不属于中耳的结构是
A. 乳突窦
B. 茎乳孔
C. 乳突小房
D. 听小骨
E. 鼓膜张肌

正确答案：B。茎乳孔

解析：中耳由鼓室、咽鼓管、乳突窦（A对）和乳突小房（C对）组成。鼓室由6个壁围成，内有听小骨（D对）、韧带、肌、血管和神经等。鼓膜张肌位于咽鼓管上方的鼓膜张肌半管内（E对）。茎乳孔（B错，为本题正确答案）是颞骨的茎突根部后方的孔。